不属于医德品质内容的是
A. 仁慈
B. 严谨
C. 诚挚
D. 公正
E. 幸福

正确答案：E。幸福

解析：医学美德论中的职业美德包括仁慈（A对）、诚挚（C对）、严谨（B对）、公正（D对）和节操等（E错，为本题正确答案）。